虎杖的后含物是
A. 草酸钙方晶
B. 草酸钙砂晶
C. 草酸钙柱晶
D. 草酸钙针晶
E. 草酸钙簇晶

正确答案：E。草酸钙簇晶

解析：本题考查的是虎杖的后含物。虎杖的后含物是草酸钙簇晶（E对）。虎杖【显微鉴别】粉末棕黄色或棕色。①草酸钙簇晶较大，直径21～110微米，棱角较钝。②韧皮纤维成束，细长，较平直，木化，纹孔细点状、人字形或十字形，胞腔内含淀粉粒，有的纤维具横隔。③分枝状石细胞，纺锤形、类长方形或延长呈纤维状。④木栓细胞扁平，数层重叠或单个散离。黄柏【显微鉴别】粉末纤维鲜黄色，常成束，周围细胞含草酸钙方晶（A错），形成晶纤维，含晶细胞壁木化增厚。石细胞鲜黄色，类圆形、纺锤形或呈分枝状，壁厚，层纹明显。草酸钙方晶众多。牛膝【显微鉴别】粉末：土黄色。①木纤维较长，壁微木化，胞腔大，具斜形单纹孔。②导管网纹、单纹孔或具缘纹孔。③薄壁细胞含草酸钙砂晶（B错）。④木薄壁细胞长方形，有的具单纹孔或网纹增厚。⑤木栓细胞类长方形，淡黄色。沉香【显微鉴别】粉末：黑棕色。①纤维管胞长梭形，多成束，壁较薄，有具缘纹孔。②韧型纤维较少见，径向壁上有单斜纹孔。③具缘纹孔导管多见，具缘纹孔排列紧密，互列，导管内棕色树脂团块常破碎脱出。④草酸钙柱晶（C错），长68㎛。天南星【显微鉴别】粉末类白色。淀粉粒以单粒为主，圆球形或长圆形，直径2～17㎛，脐点点状，裂缝状，大粒层纹隐约可见；复粒少数，由2～12分粒组成。草酸钙针晶（D错）散在或成束存在于黏液细胞中。